下列心律失常，表现为心律不整齐的是
A. 房性期前收缩
B. 一度房室传导阻滞
C. 窦性心动过速
D. 窦性心动过缓
E. 阵发性室上性心动过速

正确答案：A。房性期前收缩

解析：房性期前收缩（A对）主要表现为心悸，为心律不整齐。一度房室传导阻滞（B错）病人通常无症状。窦性心动过速（C错）、窦性心动过缓（D错）、阵发性室上性心动过速（E错）心率不齐，心律规则。